根据《药品流通监督管理办法》，药品生产企业的药品销售凭证应当
A. 保存3年或以上
B. 保存5年
C. 保存至超过药品有效期1年，但不少于2年
D. 保存至超过药品有效期1年，但不少于3年
E. 保存至超过药品有效期1年，但不少于5年

正确答案：D。保存至超过药品有效期1年，但不少于3年